人参配莱菔子在药物七情配伍关系中属
A. 相使
B. 相畏
C. 相杀
D. 相反
E. 相恶

正确答案：E。相恶

解析：人参与莱菔子相配，莱菔子能削弱人参的补气作用。相使就是以一种药物为主，一种药物为辅，两药合用，辅药可以提高主要的功效（A错）。相畏就是一种药物的毒副作用能被另一种药物所抑制（B错）。相杀就是一种药物能够消除另一种药物的毒副作用（C错）。相反就是两种药物同用能产生剧烈的毒副作用（D错）。相恶就是一种药物能破坏另一种药物的功效，莱菔子能削弱人参的补气作用，故（E对）。